下列关于绷带包扎的基本原则的叙述中，不正确的是
A. 应力求严密、稳定、美观、清洁
B. 应过度施压，以免渗血
C. 消灭无效腔，防止出血
D. 脓血外溢或渗出，应酌情加厚或更换
E. 发现绷带松动、脱落时，应及时予以加固或更换

正确答案：B。应过度施压，以免渗血

解析：本题考查绷带包扎的基本原则。下列关于绷带包扎的基本原则的叙述中，不正确的是应过度施压，以免渗血（B错，为本题正确答案）。过度施压可能影响血液循环，导致组织坏死。绷带包扎的基本原则如下：1.包扎绷带应力求严密，稳定、美观、清洁（A对）。2.压力均匀，并富有弹性。3.松紧适度，利于引流。4.注意消灭无效腔，防止出血（C对）。5.经常检查，发现绷带松动、脱落时，应及时予以加固或更换（E对）。如有脓血外溢或渗出，应酌情加厚或更换（D对）。